下列对睾丸结构的描述，何者错误
A. 睾丸实质表面的纤维膜称白膜
B. 白膜增厚向内突入形成睾丸纵隔
C. 睾丸纵隔内有睾丸网和血管
D. 精曲小管盘曲于睾丸小叶内
E. 精直小管上皮能生成精子

正确答案：E。精直小管上皮能生成精子

解析：睾丸实质表面的纤维膜为白膜（A对）、睾丸纵膈由白膜在睾丸后缘增厚进入睾丸形成（B对）、睾丸纵隔内有睾丸网和血管（C对）。每个睾丸小叶内含有2～4条盘曲的精曲小管（D对）。精子由生精小管（E错，为本题正确答案）的生精上皮产生。